各型休克的发生，最主要是由于
A. 血管容积增加
B. 血容量增加
C. 心排出量减少
D. 有效循环血量减少
E. 血液回流障碍

正确答案：D。有效循环血量减少

解析：休克是机体受到有害因素强烈袭击后所致的有效循环血容量减少（D对）、组织灌注不足、细胞代谢紊乱和器官功能受损为主的病理生理过程中所产生的一种危急综合征。引起休克的病因很多，但各类休克都有一个共同的特点，即有效循环血量急剧减少。